肝硬化气滞湿阻证的治法是
A. 温补脾肾，通阳利水
B. 滋养肝肾，育阴利水
C. 活血化瘀，利水消肿
D. 运脾利湿，行气化水
E. 疏肝理气，健脾利湿

正确答案：E。疏肝理气，健脾利湿

解析：气滞就要理气，湿阻就要祛湿、利湿、化湿这是证型和治法的基本对应。肝硬化气滞湿阻证机理为肝气郁滞，脾不健运，湿阻中焦，浊气充塞故见腹大胀满，按之软而不坚，胁下胀痛，气滞中脘，脾运失职，故见饮食减少，食后胀甚，得嗳气或矢气稍减；气滞湿阻，水道不利，故小便短少，治法当为疏肝理气，健脾利湿（E对），宜选用疏肝理气的柴胡疏肝散合健脾利湿的胃苓汤加减。温补脾肾，通阳利水（A错）是肝硬化脾肾阳虚证的常用治法；滋养肝肾，育阴利水（B错）是肝硬化肝肾阴虚证的常用治法；活血化瘀，利水消肿（C错）是肝硬化肝脾血瘀证的常用治法；运脾利湿，行气化水（D错）是脾滞湿阻证的常用治法。